女，32岁。停经90天，阴道不规则流血6天，下腹隐痛。妇科检查：宫底平脐，质软，未触及胎体，未闻及胎心。尿妊娠试验阳性。应首先考虑的诊断是
A. 羊水过多
B. 先兆流产
C. 死胎
D. 葡萄胎
E. 稽留流产

正确答案：D。葡萄胎

解析：患者为年轻女性，停经90天（怀疑早孕），阴道不规则流血6天（葡萄胎患者般在停经8～12周左右开始不规则阴道流血，量多少不定），下腹隐痛（因葡萄胎增长迅速和子宫过度快速扩张引起阵发性下腹痛，一般不剧烈，能忍受）。妇科检查：宫底平脐（为22周左右的子宫大小，大于停经月份。因葡萄胎迅速增长及宫腔内出血，约半数以上患者的子宫大于停经月份，质地变软），质软，未触及胎体，未闻及胎心（葡萄胎患者B超检查，无妊娠囊或胎心搏动）。尿妊娠试验阳性，应首先考虑的诊断是葡萄胎（D对）。羊水过多（P136）（A错）可分为急性羊水过多和慢性羊水过多，前者常见临床表现为呼吸困难，甚至发绀，不能平卧，腹壁皮肤紧绷发亮；后者较多见，多发生在妊娠晚期，症状较缓和，无明显不适或轻微胸闷或气急，两者均可触及胎体，闻及胎心，无阴道流血。先兆流产（P48）（B错）指妊娠28周前先出现少量阴道流血，随后出现阵发性下腹痛或腰背痛。妇检：子宫大小与停经周数相符。稽留流产（P49）（E错）又称过期流产，指胚胎或胎儿已死亡滞留宫腔内未能及时自然排出者。主要表现为胎动、胎心消失，子宫较停经周数小，质地不软。死胎（P120）（C错）是指妊娠20周后胎儿在子宫内死亡，与患者停经月份不符。